社区卫生服务的特点不包括
A. 持续性服务
B. 协调性，可及性服务
C. 人性化服务
D. 综合性服务
E. 治疗为主的服务

正确答案：E。治疗为主的服务

解析：本题考查社区卫生服务的特点。社区卫生服务的特点包括：①以健康为中心；②以需求为导向；③以家庭为单位；④以预防为主（E错，为本题正确答案）；⑤人性化（C对）服务；⑥综合性（D对）服务；⑦连续性服务（A对）；⑧协调性与团队合作式服务；⑨可及性服务（B对）；⑩首诊医疗服务。